置火中燃烧时发出爆鸣声且有闪光的药材是
A. 海金沙
B. 青黛
C. 儿茶
D. 冰片
E. 五倍子

正确答案：A。海金沙

解析：本题考查的是药材的火试鉴别。置火中燃烧时发出爆鸣声且有闪光的药材是海金沙（A对）。火试：是利用某些药材用火烧能产生特殊的气味、颜色、烟雾、闪光或响声等现象鉴别药材的一种方法。如降香微有香气，点燃则香气浓烈，有油状物流出，灰烬白色；海金沙火烧有爆鸣声且有闪光；青黛（B错）火烧产生紫红色烟雾等。儿茶（C错）的水浸液将火柴杆浸湿，使轻微着色，待干后，再浸入盐酸中立即取出，置火焰处烘烤，火柴杆即显深红色。冰片（D错）具挥发性，点燃发生浓烟，并有带光的火焰。五倍子（E错）：【性状鉴别】药材肚倍呈长圆形或纺锤形囊状。表面灰褐色或灰棕色，微有柔毛。质硬而脆，易破碎，断面角质样，有光泽，内壁平滑，有黑褐色死蚜虫及灰色粉末状排泄物。气特异，味涩。